经产妇，妊娠35周，今晨出现无原因，无痛性阴道流血。本例首先考虑的诊断是
A. 胎盘早期剥离
B. 先兆早产
C. 前置胎盘
D. 血小板减少性紫癜
E. 凝血功能障碍

正确答案：C。前置胎盘

解析：经产妇（多孕产次为前置胎盘的好发人群），妊娠35周(妊娠晚期），出现无原因，无痛性阴道流血（前置胎盘的典型症状为无诱因、无痛性反复阴道流血）。综合该患者的病史、临床表现，该患者首先考虑的诊断是前置胎盘（C对）。胎盘早期剥离（A错）典型症状为妊娠中期突发持续性腹痛，伴或不伴阴道流血。先兆早产（B错）指有规则或不规则宫缩，伴有宫颈管的进行性缩短。血小板减少性紫癜（D错）主要表现是皮肤黏膜出血和贫血。凝血功能障碍（E错）指凝血因子缺乏或功能异常所致的出血性疾病，主要表现为出血，以软组织、肌肉、负重关节出血为特征。